患者，女，35岁。左腋下化脓性淋巴结炎溃破，疮口仍有较多脓腐，治疗应首选
A. 五五丹
B. 三石散
C. 九一丹
D. 平胬丹
E. 白降丹

正确答案：C。九一丹

解析：患者疮口有较多脓腐，溃后脓肿切开或刺烙排脓后，可用八二丹（C对）或九一丹提脓祛腐，并用药线引流，脓净后改用生肌散收口，均可以红油膏纱布盖贴。五五丹功效提脓去腐，主治流痰，附骨疽、瘰疬等溃后腐肉难脱，脓水不净者（A错）。九一丹、八二丹、七三丹、五五丹，都是由煅石膏与升丹组成的，只是煅石膏与升丹的剂量比例不同，一般来说，疡症严重时，升丹的配比分量重，随着病情的逐步好转，而渐渐减少方剂中升丹的剂量。三石散收涩生肌作用较好，用于皮肤糜烂、稍有渗液而无红热之时，可直接干扑于皮损处，或先涂上一层油剂后再扑三石散，外加包扎（B错）。疮面胬肉突出者用平胬丹（D错）。疮口太小或成瘘管时，用白降丹、千金散药线腐蚀（E错）。